一食物中毒病人，表现为恶心、呕吐、视物模糊，继而呼吸困难、发绀、昏迷，检查有视神经和视网膜受损。此病人诊断很可能是
A. 沙门菌属食物中毒
B. 葡萄球菌肠毒素食物中毒
C. 杂醇油中毒
D. 甲醇中毒
E. 氰化物中毒

正确答案：D。甲醇中毒